以下哪项属于体内生物转化的非营养物质中外源性物质
A. 毒物
B. 药物
C. 食品添加剂
D. 环境化学污染物
E. 以上都包括

正确答案：E。以上都包括

解析：体内进行生物转化的非营养物质按其来源分为内源性和外源性两类。内源性物质包括体内物质代谢的产物或代谢中间物，如胺类、胆红素等以及发挥生理作用后有待灭活的激素、神经递质等一些对机体具有强烈生物学活性的物质。外源性物质如药物、毒物、环境化学污染物、食品添加剂和从肠道吸收来的腐败产物等。掌握“肝的生物转化”知识点。